《中国药典》规定，黄柏薄层色谱法试验的对照品是
A. 盐酸小檗碱
B. 黄柏碱
C. 黄柏酮
D. 木兰碱
E. 黄柏内酯

正确答案：A。盐酸小檗碱

解析：本题考查的是黄柏的含量测定。《中国药典》规定，黄柏薄层色谱法试验的对照品是盐酸小檗碱（A对）。黄柏【含量测定】小檗碱照高效液相色谱法（通则0512）测定。色谱条件与系统适用性试验以十八烷基硅烷键合硅胶为填充剂；以乙腈-0.1%磷酸溶液为流动相；检测波长为265nm。理论板数按盐酸小檗碱峰计算应不低于4000。对照品溶液的制备取盐酸小檗碱对照品适量，精密称定，加流动相制成每1ml含0.1mg的溶液，即得。供试品溶液的制备取本品粉末（过三号筛）约0.1g，精密称定，置100ml量瓶中，加流动相80ml，超声处理40分钟，放冷，用流动相稀释至刻度，摇匀，滤过，取续滤液，即得。